不属于牙拔除术术中并发症的一项是
A. 干槽症
B. 牙折断
C. 软组织损伤
D. 牙槽突骨折
E. 邻近软组织损伤

正确答案：A。干槽症

解析：干槽症属于术后并发症，其他几项均是术中并发症。掌握“牙拔除术并发症”知识点。